伤寒患者出现玫瑰康疹，多见于
A. 潜伏期
B. 发热初期
C. 极期
D. 缓解期
E. 恢复期

正确答案：C。极期

解析：典型的伤寒自然病程可分为4期：（1）初期，为病程的第1周，最早出现的症状是发热（B错）；（2）极期，为病程的第2～3周，玫瑰疹（C对）即为此期表现；（3）缓解期（D错），为病程的第4周，症状开始缓解，但小肠仍处于溃疡期；（4）恢复期（E错），为病程第5周，症状消失，肝脾恢复正常。伤寒潜伏期（A错）多无明显症状，其长短与伤寒沙门菌感染量及机体抵抗力有关，通常为7～14天。